依据《素问·宣明五气》理论，久卧易伤及的是
A. 气
B. 血
C. 肉
D. 精
E. 筋

正确答案：A。气

解析：《素问·宣明五气》：“久视伤血（B错）、久卧伤气（A对）、久坐伤肉（C错）、久立伤骨、久行伤筋（E错）。”是谓五劳所伤。适当的睡眠对人是非常有益的，睡眠少则会伤身，气血得不到补养。但睡眠太多对健康也是不利的，不管是健康人，还是病人，过度的睡懒觉缺乏运动，会削弱人的阳气，会使人精神萎靡，肺气虚弱，体弱无力。也会造成人体气机运化不畅，气滞血瘀，经络阻滞，即久卧伤气。